有机酸Pkₐ＜3，或有机碱的Pkₐ＞8时不易吸收
A. 脂/水分配系数与毒效应
B. 电离度与毒效应
C. 挥发度和蒸气压与毒效应
D. 绝对毒性和相对毒性与毒效应
E. 分散度与毒效应

正确答案：B。电离度与毒效应

解析：本题考查电离度与毒效应。有机酸Pkₐ＜3，或有机碱的Pkₐ＞8时不易吸收，说明其毒效应受到电离度的影响（B对ACDE错）。